最有助于提示发生急性心肌梗死的临床情况是
A. 心电图提示新出现的完全性左束支传导阻滞
B. 胸骨后刺痛
C. 左下肺湿啰音
D. 胸痛持续5分钟自行缓解
E. 血CK水平高，CK-MB/CK﹥5％

正确答案：E。血CK水平高，CK-MB/CK﹥5％

解析：急性心肌梗死可有肌酸激酶同工酶CK-MB的增高，当血中CK增高（E对）更有助于提示心肌梗死。（P204）左束支阻滞常发生于充血性心力衰竭、急性心肌梗死后、急性感染、奎尼丁与普鲁卡因胺中毒、高血压心脏病、风湿性心脏病、冠心病与梅毒性心脏病（A错）。急性心肌梗死疼痛部位和性质与心绞痛相同，多表现为压迫、发闷或紧缩性，也可为烧灼感，但不像针刺或刀扎样锐性痛（B错）。肺部局限性湿罗音可见于肺炎、肺结核或支气管扩张等，两侧肺底湿罗音多见于心力衰竭所致的肺淤血和支气管肺炎等（C错）。稳定性心绞痛疼痛持续时一般持续数分余分钟，多为3～5分钟（D错）。